某男，30岁，要求固定修复右下5，检查右下5缺失，右下4残根，叩（+），右下6牙体缺损，叩（-），余牙无异常，临床上最有效，最常用的辅助检查是
A. 制取研究模型
B. 肌电图检查
C. （牙合）力检测
D. X线平片
E. 牙髓活力检测

正确答案：D。X线平片

解析：本题考查口腔修复的辅助检查。患者男，30岁，要求固定修复右下5，检查右下5缺失，右下4残根，叩（+），右下6牙体缺损，叩（-），余牙无异常，临床上最有效，最常用的辅助检查是X线平片（D对）。固定义齿修复中，基牙是修复的基础，要求基牙要有足够的支持能力。在进行固定桥修复前，除做常规临床检查外，还应对患者的口腔局部情况做详细检查，包括缺失牙的部位和数目以及缺牙区牙槽嵴的情况；应重点检查余留牙的情况，包括余留牙的部位、数目、排列、咬合关系、磨耗或磨损、牙体或牙周病变等。所以临床上选择基牙时，最好的辅助检查是通过X线片了解牙根的大小、形态、临床冠根比以及牙槽骨的情况，便于正确选择基牙。制取研究模型（A错）、肌电图检查（B错）、（牙合）力检测（C错）、牙髓活力检测(E错）在口腔修复中都可能会用到，但不是最常用最有效的方式。